男，32岁。无痛性进行性双颈部淋巴结肿大2周入院。最可能的诊断是
A. 胃癌
B. 肺癌
C. 结核
D. 淋巴瘤
E. 炎症

正确答案：D。淋巴瘤

解析：患者青年男性，无痛性进行性双颈部淋巴结肿大2周入院（无痛性进行性淋巴结肿大是淋巴瘤的常见和突出表现，具有诊断意义），提示淋巴瘤（D对）可能性大。胃癌（P365）（A错）早期多无明显症状，进展期可有上腹痛、餐后加重、纳差、厌食、乏力及体重减轻，可在上腹部扪及肿块，常转移至左锁骨上淋巴结；肺癌（P77）常出现咳嗽、痰血及气短等症状，常转移至右锁骨上淋巴结；结核（C错）累及淋巴结，以颈部淋巴结结核多见，但有压痛；炎症（E错）累及淋巴结，常有红、肿、热、痛等表现。